患者，女，42岁。心悸气短，动则气促，神疲乏力，自汗，胸闷心痛，咳唾痰涎，舌暗苔白腻，脉弦滑，时有结代。诊断为风心病，心功能3级，其治法是
A. 益气通瘀化痰
B. 益气温阳化瘀
C. 益气温阳祛痰
D. 温阳泻肺逐饮
E. 温阳活血利水

正确答案：C。益气温阳祛痰

解析：久病体虚，损伤心阳，心失温养，故见胸闷心痛，心悸气短，动则气促；阳气亏虚，失于固摄，故见神疲乏力，自汗，咳唾痰涎；舌暗苔白腻，脉弦滑，时有结代均为心阳不足，痰浊内阻的表现，治法以益气温阳祛痰为主（C对）。益气通瘀化痰（A错）治疗气虚痰凝血瘀证。益气温阳化瘀（B错）治疗阳虚血瘀证。温阳泻肺逐饮（D错）治疗阳虚水饮内停证。温阳活血利水（E错）治疗阳虚血瘀证。